阴疮初起，红肿热痛，尚未化脓，治疗宜用
A. 仙方活命饮
B. 龙胆泻肝汤
C. 托里消毒散
D. 阳和汤
E. 五味消毒饮

正确答案：E。五味消毒饮

解析：阴疮初起，红肿热痛，尚未化脓，属于阴疮热毒证，治宜清热解毒，活血化瘀，方用五味消毒饮加减（E对）。高热肿胀，疼痛将化脓或已化脓者，可用仙方活命饮（A错）。外阴部皮肤局限性焮红肿胀，破溃糜烂，灼热结块，脓苔稠黏，或脓水淋漓，可用龙胆泻肝汤（B错）。阴疮寒凝证治宜益气养血，托毒外出，方用托里消毒散（C错）。若阳虚寒凝，治当温经散寒，化痰养荣，阳和汤（D错）合小金丹治之。